肝素抗凝血的主要机制是
A. 抑制X因子的激活
B. 增强抗凝血酶Ⅲ的活性
C. 去除Ca²⁺
D. 促进纤维蛋白溶解
E. 抑制血小板的作用

正确答案：B。增强抗凝血酶Ⅲ的活性

解析：肝素的生物活性主要取决于血浆蛋白酶抑制剂抗凝血酶，抗凝血酶含有精氨酸-丝氨酸肽活性部位，与许多凝血因子及纤维蛋白溶酶发生缓慢的化学结合，形成稳定的复合物从而抑制些凝血因子，发挥抗凝作用。肝素的抗凝机制是由抗凝血酶介导，从而间接抑制凝血酶，带负电荷的肝素可与正电荷的抗凝血酶赖氨酸残基形成可逆性复合物，使抗凝血酶构型发生变化，充分暴露其活性中心，抗凝血酶的精氨酸残基迅速与酶活性中心结合，从而加速抗凝血酶对凝血因子的灭活（B对）。抑制X因子的激活（A错）（P266）为口服抗凝药物华法林的作用机制。去除Ca2+（C错）为体外抗凝剂枸橼酸钠的抗凝机制。促进纤维蛋白溶解（D错）（P267）为溶栓药物的作用机制。抑制血小板的作用（E错）（P270）为抗血小板药阿司匹林的作用机制。